嵌体洞壁必须有牙本质支持目的是
A. 增加固位力
B. 防龋
C. 增加摩擦力
D. 增加抗力
E. 增加覆盖面积

正确答案：D。增加抗力

解析：牙本质支持主要是有厚度的保证，牙体组织多，能够抵抗较大的咬合压力，因此对于牙本质支持的要求，主要是满足抗力形上的要求。掌握“金属嵌体”知识点。